某男，56岁。1年前被确诊为肾结石、慢性肾炎、前列腺增生症。刻下血尿1天，伴腰腹疼痛、排尿不畅。经碎石治疗后，为巩固疗效，又请中医诊治，因工作繁忙无暇煎药，要求服用中成药，医师遂处以排石颗粒，以善其后。1年后，患者再请中医诊治。诉云：服用上药2月血尿已止，尿蛋白也减轻，余症均得以缓解，唯时有腰膝酸软、足踝肿，之后，遂停药。近日因老朋友聚会小酌几杯，又见尿频、尿急、尿痛、尿线细，并伴小腹拘急疼痛。医师诊断为肾气不足、湿热瘀阻证，宜选用的中成药是
A. 三金片
B. 癃清片
C. 癃闭舒胶囊
D. 五苓散
E. 八正合剂

正确答案：C。癃闭舒胶囊

解析：本题考查的是癃闭舒胶囊的主治。尿频、尿急、尿痛、尿线细，并伴小腹拘急疼痛。医师诊断为肾气不足、湿热瘀阻证，宜选用的中成药是癃闭舒胶囊（C对）。癃闭舒胶囊：【主治】肾气不足、湿热瘀阻所致的癃闭，症见腰膝酸软、尿频、尿急、尿痛、尿线细，伴小腹拘急疼痛；前列腺增生症见上述证候者。三金片（A错）：【主治】下焦湿热所致的热淋，症见小便短赤、淋沥涩痛、尿急频数；急性肾盂肾炎、慢性肾盂肾炎、膀胱炎、尿路感染见上述证候者；慢性非细菌性前列腺炎肾虚湿热下注证。癃清片（B错）：【主治】下焦湿热所致的热淋，症见尿频、尿急、尿痛、腰痛、小腹坠胀。亦用于慢性前列腺炎之湿热蕴结兼瘀血证，症见小便频急，尿后余沥不尽，尿道灼热，会阴少腹腰骶部疼痛或不适等。五苓散（D错）：【主治】阳不化气、水湿内停所致的水肿，症见小便不利、水肿腹胀、呕逆泄泻、渴不思饮。八正合剂（E错）：【主治】湿热下注所致的淋证，症见小便短赤、淋沥涩痛、口燥咽干等。